下列关于淋病的临床表现，错误的是
A. 急性淋病在淋菌侵入14天后发病
B. 急性淋病包括上生殖道和下生殖道感染
C. 上生殖道感染半数通过血行传播
D. 妇女感染淋病后多无症状
E. 急性淋菌性盆腔炎多在月经期或经后1周内发病

正确答案：C。上生殖道感染半数通过血行传播

解析：淋病奈瑟菌急性感染后，多在淋菌侵入14天后发病（A对）。急性淋病感染主要累及下生殖道，但上生殖道也会累及（B对）。上生殖道感染主要沿生殖道黏膜蔓延（C错，为本题正确答案）。妇女感染淋病后临床表现主要是阴道脓性分泌物增多，外阴瘙痒、灼痛，但多数无症状（D对）。月经期或经后一周抵抗力低，急性淋菌性盆腔炎多在此时发病（E对）。